某女性患者，59岁。间断喘息发作5年，无明显规律，发作间期无不适。此次因“气喘6小时”急诊入院。查体：T36.8℃，端坐呼吸，口唇发绀，双侧呼吸音低，呼气相显著延长，未闻及哮鸣音。临床诊断为支气管哮喘，治疗该病最有效的药物是
A. 沙丁胺醇
B. 色甘酸钠
C. 曲尼司特
D. 布地奈德
E. 氨茶碱

正确答案：D。布地奈德

解析：本题考查支气管哮喘的治疗。某女性患者，59岁。间断喘息发作5年，无明显规律，发作间期无不适。此次因“气喘6小时”急诊入院。查体：T36.8℃，端坐呼吸，口唇发绀，双侧呼吸音低，呼气相显著延长，未闻及哮鸣音。临床诊断为支气管哮喘，治疗该病最有效的药物是布地奈德（D对），属于糖皮质激素，可作用于气道炎症形成过程中的诸多环节，有效抑制气道炎症。。沙丁胺醇（A错）属于短效β2受体激动剂，是治疗哮喘急性发作的首选药。色甘酸钠（B错）无扩张气道作用，可通过稳定肥大细胞膜、抑制气道感觉神经末梢与气道神经源性炎症、阻断炎症细胞介导的反应来抑制气道痉挛，可作为预防哮喘发作的药物。曲尼司特（C错）属于白三烯阻断药，可用于成人和12岁以上儿童支气管哮喘的长期治疗和预防。氨茶碱（E错）可通过抑制磷酸二酯酶，提高平滑肌细胞内的环腺苷酸浓度，拮抗腺苷受体，增强呼吸肌的力量以及增强气道纤毛清除功能等，从而起到舒张支气管和气道抗炎作用，是目前治疗哮喘的有效药物之一。